固定义齿修复属于龋病的
A. 零级预防
B. 一级预防
C. 二级预防
D. 三级预防
E. 不属于龋病三级预防

正确答案：D。三级预防

解析：本题考查龋病的分级预防。固定义齿修复属于龋病的三级预防（D对）。龋病的分级预防包括一级预防、二级预防和三级预防。一级预防是针对病因的预防，从控制龋病的危险因素入手，预防龋病的发生；二级预防强调的是在龋病的早期进行有效的控制，防止龋病的危害扩大；三级预防是进行龋病的功能修复。三级预防是比较被动的，从预防的角度讲，一级预防最为重要，其次是二级预防，做到龋病的早期控制。1.一级预防（B错）：①进行口腔健康教育：普及口腔健康知识，了解龋病发生的知识，树立自我保健意识，养成良好的饮食习惯和口腔卫生习惯。②控制及消除危险因素：对口腔内存在的危险因素，应采取可行的防治措施。定期口腔检查，在口腔医师的指导下，合理使用各种氟化物及其他的防龋方法，如窝沟封闭、防龋涂料等。2.二级预防（C错）：早期诊断、早期处理，定期进行临床检查及X线辅助检查，发现早期龋及时充填，避免龋损的进一步发展和破坏。3.三级预防：①防止龋病的并发症：治疗深龋以防止龋病进一步发展伤害牙髓引起牙髓炎并继续发展成根尖周炎。②恢复功能：对龋病引起的牙体缺损、缺失及牙列缺损，应及时修复，以恢复口腔正常功能，保持身体健康。对不能保留的牙应及时拔除。